孕激素
A. 使阴道上皮细胞增生角化
B. 使阴道上皮细胞脱落加快
C. 能直接调控卵巢的周期性变化
D. 促进阴毛与腋毛生长
E. 抑制腺垂体卵泡刺激素分泌

正确答案：B。使阴道上皮细胞脱落加快

解析：孕激素能使阴道上皮细胞脱落加快（B对）。使阴道上皮细胞增生角化（A错）是雌激素的作用（P20）。能直接调控卵巢的周期性变化（C错）是促卵泡刺激素和黄体生成素的共同作用（P25）。促进阴毛与腋毛生长（D错）是雄激素的作用。在月经周期的黄体期，大量的孕激素和雌激素以及抑制素A对下丘脑-垂体的负反馈作用，抑制腺垂体卵泡刺激素分泌（E错）和黄体生成素的分泌（P26）。